舌淡白胖嫩，苔白滑者，常提示的是
A. 阴虚夹湿
B. 脾胃湿热
C. 气分有湿
D. 阳虚水停
E. 瘀血内阻

正确答案：D。阳虚水停

解析：舌体颜色、形质主要反映脏腑气血津液的情况，舌苔的变化主要与感受病邪和病证的性质有关。阴虚在舌的表现为舌体瘦，舌质红（A错）。脾胃湿热多见舌质红，苔黄腻（B错）。气分有湿苔白滑腻（C错）。淡白舌主气血两虚、阳虚，加之舌体胖嫩，多为阳虚水湿内停，苔白滑多为外感寒湿或脾肾阳虚，水湿内停，两者结合判为阳虚水停（D对）。瘀血内阻多见舌质暗，有瘀斑（E错）。